破坏疟原虫生物膜及蛋白质，致虫体死亡的抗疟药是
A. 氯喹
B. 伯氨喹
C. 乙胺嘧啶
D. 奎宁
E. 青蒿素

正确答案：E。青蒿素

解析：本题考查抗疟药的作用机制。破坏疟原虫生物膜及蛋白质，致虫体死亡的抗疟药是青蒿素（E对）。青蒿素通过产生自由基，对恶性疟原虫红细胞内期的生物膜产生严重破坏作用，或与原虫蛋白结合，使之死亡，对红细胞内期滋养体有杀灭作用，对红细胞外期疟原虫无效。用于控制间日疟和恶性疟的症状以及耐氯喹疟疾的治疗。氯喹（A错）抗疟作用机制复杂，与氯喹在疟原虫溶酶体内的高度浓集有关。①氯喹能与疟原虫DNA双螺旋链中的鸟嘌呤、胞嘧啶碱基对结合，形成氯喹-DNA复合物，抑制DNA的复制和转录，并使DNA断裂，抑制疟原虫的繁殖；②氯喹是弱碱性药物，容易大量进入疟原虫体内，使虫体细胞内的pH升高，形成对蛋白质分解酶不利的环境，使疟原虫分解和利用血红蛋白的能力降低，导致氨基酸缺乏而抑制疟原虫的生长繁殖；③红细胞内期裂殖体破坏红细胞后产生疟色素，其组分高铁原卟啉被认为是氯喹等抗疟药的高亲和性受体，与氯喹结合，可破坏疟原虫细胞膜，使疟原虫溶解。伯氨喹（B错）的抗疟机制尚不清楚，可能与其诱导疟原虫的活性氧产生或干扰其线粒体电子转运有关。乙胺嘧啶（C错）能抑制疟原虫的二氢叶酸还原酶，使其叶酸代谢受阻，从而影响疟原虫的核酸合成，使其生长繁殖受到抑制。奎宁（D错）作用及其机制与氯喹相似，对各种疟原虫红细胞内期滋养体有杀灭作用，能控制临床症状，但作用较弱，对红细胞外期及配子体无明显作用。